急性放射病的临床表现可分为
A. 骨髓型、胃肠型和脑型
B. 骨髓型、皮肤型和脑型
C. 肿瘤型、胃肠型和脑型
D. 骨髓型、胃肠型和肺型
E. 淋巴细胞型、胃肠型和脑型

正确答案：A。骨髓型、胃肠型和脑型